远中错（牙合）是指
A. 上颌第一恒磨牙的近中颊尖咬合在下颌第一恒磨牙颊沟的远中
B. 下颌第一恒磨牙的近中颊尖咬合在上颌第一恒磨牙颊沟的远中
C. 上颌第一恒磨牙的近中颊尖正对着下颌第一恒磨牙颊沟
D. 下颌第一恒磨牙的近中颊尖正对着上颌第一恒磨牙颊沟
E. 上颌第一恒磨牙的近中颊尖咬合在下颌第一恒磨牙颊沟的近中

正确答案：E。上颌第一恒磨牙的近中颊尖咬合在下颌第一恒磨牙颊沟的近中

解析：如在上颌第一恒磨牙的近中颊尖咬合在下颌第一恒磨牙的颊沟的近中，则称为远中错（牙合），或安氏Ⅱ类错（牙合）。掌握“牙尖交错（牙合）、前伸（牙合）及侧（牙合）”知识点。